结核性心包炎初期最关键的治疗是
A. 口服泼尼松
B. 抗结核治疗
C. 营养支持治疗
D. 心包穿刺引流
E. 口服利尿药

正确答案：B。抗结核治疗

解析：结核性心包炎初期最关键的治疗是抗结核治疗（B对）。口服泼尼松（A错）一般用于治疗用于过敏性与自身免疫性炎症性疾病，胶源性疾病，如风湿病、类风湿性关节炎、红斑狼疮、严重支气管哮喘、肾病综合症、血小板减少性紫癜等。营养支持治疗（C错）是很多疾病的常规治疗，不作为结核性心包炎的最关键治疗。心包穿刺引流（D错）是解除心脏压塞最简单、有效的手段，一般用于所有血流动力学不稳定的急性心脏压塞。口服利尿药（E错）一般用于治疗高血压、心衰、肾衰等疾病。